呼吸困难、胸闷、咳嗽、发绀属于
A. 高血压的临床表现
B. 糖尿病的临床表现
C. 高脂血症的临床表现
D. 消化性溃疡的临床表现
E. 支气管哮喘的临床表现

正确答案：E。支气管哮喘的临床表现

解析：本题考查支气管哮喘的临床症状。呼吸困难、胸闷、咳嗽、发绀属于支气管哮喘的临床表现（E对）。支气管哮喘的临床表现：发作性的喘息、气急、呼吸困难、胸闷或咳嗽等症状，少数患者还可能以胸痛为主要表现。高血压的临床表现（A错）有头痛、头晕、心悸。糖尿病的临床表现（B错）：患者并无明显症状，部分可出现多饮、多尿、多食、消瘦和体重减轻、疲乏无力等。高脂血症的临床表现（C错）：主要是黄色瘤、早发性角膜环和脂血症眼底改变，动脉粥样硬化。消化性溃疡的临床表现（D错）：周期性上腹疼痛呈反复周期性发作，节律性溃疡疼痛与饮食之间的关系具有明显的相关性和节律性，疼痛性质多呈钝痛、灼痛或饥饿样痛等。